具有诱导肝药酶作用的药物是
A. 利福平
B. 西咪替丁
C. 氯霉素
D. 酮康唑
E. 别嘌醇

正确答案：A。利福平

解析：本题考查酶的诱导与抑制。利福平（A对）可诱导肝药酶活性；西咪替丁（B错）、氯霉素（C错）、酮康唑（D错）、别嘌醇（E错）都是抑制肝药酶活性药物。